含雄黄而不宜大量或长期服用的中成药是
A. 牛黄解毒丸
B. 牛黄上清丸
C. 龙胆泻肝丸
D. 开胸顺气丸
E. 牛黄降压丸

正确答案：A。牛黄解毒丸

解析：本题考查的是含雄黄的中成药。含雄黄而不宜大量或长期服用的中成药是牛黄解毒丸（A对）。含雄黄的中成药：牛黄解毒丸（片）、六神丸、喉症丸、安宫牛黄丸、牛黄清心丸、牛黄镇惊丸、牛黄抱龙丸、牛黄至宝丸、追风丸、牛黄醒消丸、紫金锭（散）、三品等。牛黄上清丸（B错）：【药物组成】人工牛黄、黄芩、黄连、黄柏、大黄、栀子、石膏、菊花、连翘、荆芥穗、白芷、薄荷、赤芍、地黄、当归、川芎、冰片、桔梗、甘草。龙胆泻肝丸（C错）：【药物组成】龙胆、黄芩、栀子（炒）、车前子（盐炒）、泽泻、木通、当归（酒制）、地黄、柴胡、甘草（炙）。开胸顺气丸（D错）与牛黄降压丸（E错）的药物组成，2022年考试指南未明确说明。